支配下斜肌
A. 眼神经
B. 上颌神经
C. 滑车神经
D. 动眼神经
E. 展神经

正确答案：D。动眼神经

解析：眼神经（A错）分布于眶内、眼球、泪器、结膜、硬脑膜、部分鼻和鼻旁窦黏膜、额顶部及上脸和鼻背部的皮肤。上颌神经（B错）发出分支分布于上颌牙、牙限、鼻腔黏膜、软腭黏膜，穿出眶下孔后分支分布于眼睑及睑裂与口裂之间的皮肤。滑车神经（C错）支配上斜肌。动眼神经（D对）上支细小，分布于上直肌和上睑提肌，下支粗大，支配下直肌、内直肌和下斜肌。展神经（E错）支配外直肌。